酸中毒诱发心衰的机制主要是
A. H+与Ca2+竞争结合肌钙蛋白
B. 毛细血管括约肌痉挛
C. 高血钾促进心肌Ca2+内流
D. H+使血流阻力增加
E. 使心肌细胞动作电位不能产生

正确答案：A。H+与Ca2+竞争结合肌钙蛋白

解析：酸中毒时，H+可与Ca2+竞争结合肌钙蛋白（A对），使Ca2+无法有效与肌钙蛋白结合，心肌兴奋-收缩耦联过程受阻，诱发心衰。酸中毒还可引起高钾血症，抑制心肌Ca2+内流（C错）。酸中毒主要通过影响心脏兴奋-收缩耦联过程而不是心肌细胞动作电位产生（E错）诱发心衰。